男性，71岁吸烟患者。反复咳嗽、咳痰、气促40余年，胸闷、心悸2年，加重伴发热1周，昏睡3小时入院。入院后查体：BP140/90mmHg，嗜睡状，呼之能应，瞳孔等大等圆，对光反射存在，口唇发绀，双肺可闻及湿啰音，心率120次/分，早搏3次/分，下肢凹陷性水肿。该患者最可能的诊断是
A. 冠状动脉硬化性心脏病
B. 慢性肺源性心脏病
C. 风湿性心脏病
D. 原发性心肌病
E. 高血压心脏病

正确答案：B。慢性肺源性心脏病

解析：患者老年男性，长期吸烟史，反复咳嗽、咳痰、喘息40余年（为慢阻肺的典型症状），查体有肺气肿体征，考虑有慢性阻塞性肺病（COPD），胸闷、心悸，心率120次/分，下肢凹陷性水肿，为右心衰表现，根据其临床表现和体征，故考虑为慢性肺源性心脏病（B对）。冠状动脉硬化性心脏病（A错）（P219）表现为突感心前区疼痛，多为发作性绞痛或压榨痛，疼痛从胸骨后或心前区开始，向上放射至左肩、臂，甚至小指和无名指，休息或含服硝酸甘油可缓解，与该患者表现不符。本题中未提及患者有风湿性疾病，故不考虑风湿性心脏病（C错）。原发性心肌病（D错）多在排除其他诱因导致心脏疾病时考虑。患者查体虽有血压高，但由于并未叙述患者长期高血压病史，且肺心病急性期由于肺动脉高压也可暂时出现高血压，因此不首先考虑高血压心脏病（E错）（P250）。